对病例对照研究的资料可计算
A. 相对危险度
B. 特异危险度
C. 比值比
D. 发病率
E. 罹患率

正确答案：C。比值比